细菌性痢疾的病变部位主要是
A. 乙状结肠、直肠
B. 空肠
C. 回肠
D. 十二指肠
E. 以上都不是

正确答案：A。乙状结肠、直肠

解析：细菌性痢疾病变部位主要发生于大肠，尤以乙状结肠和直肠为重。掌握“细菌性痢疾”知识点。